用重量法测定某试样中的Fe，沉淀形式为Fe（OH）₃·nH2O，称量形式为Fe₂O₃，换算因数为
A. Fe/Fe（OH）₃·nH₂0
B. Fe/Fe₂O₃
C. 2Fe/Fe₂O₃
D. Fe₂O₃/Fe
E. Fe₂O₃/2Fe

正确答案：C。2Fe/Fe₂O₃